成釉细胞瘤多房型错误的是
A. 分房大小相等
B. 唇颊侧为主
C. 分隔清晰锐利
D. 椭圆形密度减低影
E. 被侵蚀呈锯齿状或截断状

正确答案：A。分房大小相等

解析：本题考查成釉细胞瘤的病理分型。成釉细胞瘤多房型错误的是分房大小相等（A错，为本题正确答案）。成釉细胞瘤多房型：分房大小相差悬殊，房呈圆形或椭圆形密度减低影（D对），分隔清晰锐利（C对）。颌骨骨质膨胀，以向唇颊侧为主（B对）。邻牙可被肿瘤推压而移位，也可被侵蚀呈锯齿状或截断状（E对）。